老年男性，患慢性阻塞性肺病5～6年，今年入冬以来病情加重，动则喘甚，呼多吸少，气不得续，形瘦神惫，跗肿，汗出肢冷，面青唇紫，舌淡苔白，脉沉弱，其中医治法是
A. 补肺益气养阴
B. 补肾纳气
C. 扶阳固脱，镇摄肾气
D. 清热化痰，宣肺止咳
E. 温肺化饮，散寒止咳

正确答案：B。补肾纳气

解析：本题患者有慢性阻塞性肺疾病，久病肺虚及肾，气失摄纳故见呼多吸少，气不得续，动则喘甚；肾虚精气耗损，则见形瘦神惫；肾阳既衰，卫外之阳不固故汗出；阳气不能温养于外，则肢冷、面青；阳虚气不化水而见跗肿。气虚不能鼓动血脉，瘀血内停，颜面缺荣，则唇紫。舌苔淡白、脉沉弱均为肾阳衰弱之征，宜补肾纳气（B对）；补肺益气养阴用于气阴两虚，心悸气短者（A错）；扶阳固脱，镇摄肾气喘脱证，症状：喘逆甚剧，张口抬肩，鼻翼煽动，端坐不能平卧，稍动则喘剧欲绝，或有痰鸣，咳吐泡沫痰，心慌动悸，烦躁不安，面青唇紫，汗出如珠，肢冷，脉浮大无根，或见歇止，或模糊不清（C错）；清热化痰，宣肺止咳用于痰热郁肺证，症状：咳逆喘息气粗，烦躁胸满，痰黄或白，黏稠难咯，或身热微恶寒，有汗不多，溲黄便干，口渴，舌红，苔黄或黄腻，脉数或滑数（D错）；温肺化饮，散寒止咳用于外寒内饮证，症状：咳逆喘息不得卧，痰多稀薄，恶寒发热，背冷无汗，渴不多饮，或渴喜热饮，面色青酶，舌苔白滑，脉弦紧（E错）。